麻疹的特殊体征是
A. 高热
B. 咳嗽
C. 眼泪汪汪
D. 喷嚏鼻涕
E. 麻疹粘膜斑

正确答案：E。麻疹粘膜斑

解析：麻疹是感受麻疹时邪引起的一种以发热，咳嗽咽痛，鼻塞流涕，眼泪汪汪，畏光羞明，口腔两颊近臼齿处可见麻疹黏膜斑为特征的疾病（E对）。高热、咳嗽、喷嚏鼻涕为呼吸道感染疾病常见症状，无特异性（ABD错）。眼泪汪汪除了麻疹外，眼科疾病也常见此症状，还可因物理因素导致，例如切洋葱（C错）。